属于次生苷的是
A. 苦杏仁苷
B. 野樱苷
C. 二者皆可
D. 二者皆不可

正确答案：B。野樱苷

解析：本题考查的是苷类化合物的分类。属于次生苷的是野樱苷（B对）。按苷类在植物体内的存在状况分类：原存在于植物体内的苷称为原生苷，水解后失去一部分糖的称为次生苷。例如苦杏仁苷（A错）是原生苷，水解后失去一分子葡萄糖而成的野樱苷就是次生苷。